麻醉前用药的目的，下列哪项是错误的
A. 消除患者紧张心情
B. 提高患者的痛阈
C. 抑制呼吸道腺体约分泌
D. 消除因手术及麻醉引起的不良反射
E. 缩短手术时间

正确答案：E。缩短手术时间

解析：麻醉前用药的目的：1.解除精神紧张（A对）和恐惧心理，使病人在麻醉前能够情绪稳定，充分合作。2.提高痛阈（B对），增强麻醉效果和全身麻醉药的效果，减少全麻药用量及其副作用。3.控制不良反应，降低基础代谢，减少氧耗量，减少呼吸道腺体分泌（C对），抑制迷走神经反射，以维持血流动力学的稳定。4.拮抗麻醉药的副作用，降低麻醉药的毒性（D对）。本题问的是哪项错误，故选E。